患儿乳磨牙深龋洞，穿髓孔大，龋洞充满息肉，蒂部来源为牙髓，据此可以诊断为
A. 急性牙髓炎
B. 慢性溃疡性牙髓炎
C. 牙髓坏死
D. 牙髓钙化
E. 慢性增生性牙髓炎

正确答案：E。慢性增生性牙髓炎

解析：慢性增生性牙髓炎常见穿髓孔较大的乳磨牙，外伤冠折露髓之后的乳前牙。诊断依据为患牙有穿髓孔大的深龋洞、洞内充满息肉，对刺激不敏感，其蒂部来源牙髓。掌握“乳牙牙髓病及根尖周病诊断及治疗”知识点。